在体内以黄素单核苷酸和黄素腺嘌呤核苷酸（FAD）的形式存在的药物是
A. 维生素B₁
B. 维生素B₆
C. 维生素C
D. 维生素B₁₂
E. 维生素B₂

正确答案：E。维生素B₂

解析：本题考查维生素B₂。维生素B₂（E对）在人体内以黄素腺嘌呤二核苷酸（FAD）和黄素单核苷酸（FMN）两种形式存在，广泛参与细胞氧化还原系统传递氢的反应。维生素B₁（A错）在体内为脱羧辅酶的组成成分。维生素B₆（B错）在红细胞内转化为磷酸吡哆醛，为人体必需的一种辅酶。维生素C（C错）为酸性己糖衍生物，是烯醇式己糖酸内酯。维生素B₁₂（D错）是唯一含金属元素的维生素。